临产调护六字要诀是
A. 惜力、忍痛、勿慌
B. 睡、忍痛、慢临盆
C. 安静、忍痛、整洁
D. 安静、睡眠、忍痛
E. 睡、忍痛、少活动

正确答案：B。睡、忍痛、慢临盆

解析：该题考查临产调护内容，属记忆内容。古代《达生篇》中总结出临产六字真言“睡、忍痛、慢临盆”，对产妇顺利分娩有一定指导意义（B对）。